某女，25岁。肌肤下肿块数处、推之能动、皮色不变、肿硬作痛。证属痰气凝滞，宜选用的成药是
A. 消风止痒颗粒
B. 连翘败毒丸
C. 当归苦参丸
D. 小金丸
E. 消银颗粒

正确答案：D。小金丸

解析：本题考查的是小金丸的主治。痰气凝滞，宜选用的成药是小金丸（D对）。小金丸【主治】痰气凝滞所致的瘰疬、瘿瘤、乳岩、乳癖，症见肌肤或肌肤下肿块一处或数处、推之能动，或骨及骨关节肿大、皮色不变、肿硬作痛。消风止痒颗粒（A错）【主治】风湿热邪蕴阻肌肤所致的湿疮、风疹瘙痒、小儿瘾疹，症见皮肤丘疹、水疱、抓痕、血痂、或见梭形或纺锤形水肿性风团、中央出现小水疱、瘙痒剧烈；湿疹、皮肤瘙痒症、丘疹性荨麻疹见上述证侯者。连翘败毒丸（B错）【主治】热毒蕴结肌肤所致的疮疡，症见局部红肿热痛、未溃破者。当归苦参丸（C错）【主治】湿热瘀阻所致的粉刺、酒皶，症见颜面、胸背粉刺疙瘩、皮肤红赤发热，或伴脓头、硬结，酒皶鼻、鼻赤。消银颗粒（E错）【主治】血热风燥型白疕和血虚风燥型白疕，症见皮疹为点滴状、基底鲜红色、表面覆有银白色鳞屑、或皮疹表面覆有较厚的银白色鳞屑、较干燥、基底淡红色、瘙痒较甚。